NK细胞表面没有
A. CD16
B. CD56
C. FcR Ⅲ
D. TCR
E. CKR

正确答案：D。TCR